保健食品产品注册证有效期为
A. 2年
B. 3年
C. 5年
D. 10年
E. 20年

正确答案：C。5年

解析：本题考查保健食品产品注册证的有效期。保健食品产品注册证有效期为5年（C对ABDE错）。有效期届满需要延续的，注册人应当在有效期届满6个月前申请延续。